某学校派校医参加当地中小学保健所和疾病预防控制中心举办的常见病防治知识培训班，是为了提高学校的
A. 学校卫生政策
B. 学校物质环境
C. 学校社会环境
D. 个人健康技能
E. 卫生服务

正确答案：E。卫生服务